薄荷除宣散风热外，还能
A. 平肝明目
B. 解毒透疹
C. 清肺润燥
D. 疏肝
E. 息风止痉

正确答案：D。疏肝

解析：本题考查的是薄荷的功效。薄荷除宣散风热外，还能疏肝（D对）。薄荷：【功效】宣散风热，清利头目，利咽，透疹，疏肝。桑叶：【功效】疏散风热，清肺润燥（C错），平肝明目（A错），凉血止血。牛蒡子：【功效】疏散风热，宣肺利咽，解毒透疹（B错），消肿疗疮。蝉蜕：【功效】疏散风热，透疹止痒，明目退翳，息风止痉（E错）。